关于农村社区健康教育的形式，下列陈述不正确的是
A. 深入开展“九亿农民健康教育行动”
B. 开发利用农村传播媒介和渠道
C. 培训家庭保健员，开展“卫生科普人户”活动
D. 结合农村疾病防治，开展健康教育
E. 以宣传为重点

正确答案：E。以宣传为重点